遗传咨询和产前诊断的对象，不包括以下哪项
A. 既往分娩先天性严重缺陷婴儿
B. 父亲有遗传病家族史
C. 年龄超过35岁的高龄产妇
D. 既往有流产病史者
E. 孕期接受放射线照射者

正确答案：D。既往有流产病史者

解析：本题考查产前诊断的对象。既往有流产病史者（D错，为本题正确答案）不属于产前诊断的对象。产前诊断的对象为出生缺陷高危人群，孕妇有下列情形之一的，应建议进行产前诊断：（1）有羊水过多或过少；（2）筛查发现染色体核型异常的高危人群、胎儿发育异常或可疑结构畸形；（3）妊娠早期接触过可能导致胎儿先天缺陷的物质，如放射线照射者（E对）；（4）夫妇一方患有先天性疾病或遗传性疾病或有遗传病家族史（B对）；（5）曾经分娩过先天性严重缺陷婴儿（A对）；（6）年龄达到或超过35周岁（C对）。